关于鼓岬的描述，错误的是
A. 位于迷路壁的中部
B. 岬是骨性蜗管基底的外侧壁
C. 下方有咽鼓管鼓室端的开口
D. 后上方有前庭窗
E. 无

正确答案：C。下方有咽鼓管鼓室端的开口

解析：内侧壁又称迷路壁，其中部（A对）有圆形的隆起称岬。岬的后上方有一卵圆形小孔，称前庭窗（D对）或卵圆窗，通向前庭。岬的后下方有一圆形小孔，称蜗窗或圆窗，在活体上由第二鼓膜封闭（C错，为本题正确答案）。